女性，65岁。冠心病心绞痛史8年，无高血压史，夜间突发心前区疼痛8小时入院，入院时血压为150/90mmHg（20/12kPa），经心电图检查，诊断急性前壁心肌梗死。上述患者出现频发室性早搏，有时呈短阵室速，最恰当的处理是
A. 静滴维拉帕米
B. 口服美西律
C. 静脉使用利多卡因
D. 口服普鲁卡因酰胺
E. 静点硝酸酯类药物

正确答案：C。静脉使用利多卡因

解析：患者老年女性，心绞痛史8年，突发急性前壁心肌梗死8小时，出现频发室性早搏，有时呈短阵室速，此时最恰当的处理为静脉使用利多卡因（C对）。利多卡因（九版药理学P196）主要治疗室性心律失常，如心脏手术、心导管术、急性心肌梗死或强心苷中毒所致的室性心动过速或心室纤颤。根据九版内科学P197指出，对于有慢性心脏病变如心肌梗死后或心肌病伴有室性期前收缩的患者，不主张使用Ⅰ类药物治疗，原因是这些抗心律失常药物本身具有导致心律失常作用，致使远期死亡率和猝死风险反而增加。但本例患者只有心绞痛病史8年，并无心肌梗死或心肌病病史，故治疗原则应按急性心肌梗死来治疗。本题为老试题，有点争议，但答案为静脉使用利多卡因应更合理。维拉帕米（A错）为非二氢吡啶类钙通道拮抗剂，主要适用于各种室上性心动过速，房室折返性心动过速等。美西律（B错）和普鲁卡因酰胺（D错）可用于室性心律失常的治疗，但并非本例的最恰当处理，具体适应证可参考九版内科学P206表3-3-5。硝酸酯类药物（P239）（E错）可扩张静脉，降低心脏前负荷，降低心肌耗氧量，改善心功能；还可扩张冠状动脉，缓解心肌缺血。主要用于急性冠脉综合征的抗缺血治疗。